糖皮质激素
A. 促进葡萄糖的利用
B. 减少红细胞和淋巴细胞的数目
C. 促进脂肪的分解
D. 促进肌肉组织蛋白质分解
E. 降低机体抗伤害刺激的能力

正确答案：D。促进肌肉组织蛋白质分解

解析：糖皮质激素（GC）的生理作用：①GC对肝内和肝外组织细胞的蛋白质代谢影响不同，对肝外组织GC抑制蛋白质合成，加速其分解，减少氨基酸转运入肌肉组织（D对）：对肝内组织GC促进蛋白质合成，促进肝外组织产生的氨基酸转运入肝内。②GC主要通过减少组织对糖的利用和加速肝糖异生也可抑制胰岛素与其受体结合而使血糖升高（A错）。③GC可使红细胞、血小板和中性粒细胞计数增加，淋巴细胞和嗜酸性粒细胞计数减少（B错）④GC可促使脂肪重新分布，四肢脂肪分解，头面躯干脂肪合成增强，产生水牛背，满月脸（C错）⑤当机体遭受到各种有害刺激时，启动下丘脑-腺垂体-肾上腺皮质系统，刺激糖皮质激素快速大量分泌，引起机体非特异性防御反应（E错）。⑥GC还有保钠排水排钾的作用，但较醛固酮作用弱。